清心安神的药物是
A. 玉竹
B. 百合
C. 石斛
D. 北沙参
E. 女贞子

正确答案：B。百合

解析：以上选项皆为补阴药。百合甘，寒；归心、肺经。入心经，能养阴清心，宁心安神（B对）。治虚热上扰，失眠，心悸，可与麦冬、酸枣仁、丹参等清心安神药同用；治百合病心肺阴虚内热，症见神志恍惚，情绪不能自主，口苦，小便赤、脉微数等。本品既能养肺之阴，又能清心肺之热，还有一定的安神作用。